草麻黄药材的性状特征是
A. 呈细长圆柱形，少分枝
B. 膜质鳞叶裂片通常3，先端不反曲
C. 体轻，质脆，易折断
D. 断面略呈纤性维，髓部红棕色
E. 气微香，味涩、微苦

正确答案：A、C、D、E。呈细长圆柱形，少分枝；体轻，质脆，易折断；断面略呈纤性维，髓部红棕色；气微香，味涩、微苦